患者，男，16岁，因“急性细菌性扁桃体炎”使用青霉素钠治疗，用药前进行青霉素皮试。关于青霉素皮试液浓度和给药方法的说法，正确的是
A. 浓度5000U/ml，皮内注射0.1ml
B. 浓度5000U/ml，肌内注射0.1ml
C. 浓度500U/ml，皮内注射0.1ml
D. 浓度500U/ml，肌内注射0.1ml
E. 浓度500U/ml，皮内注射1ml

正确答案：C。浓度500U/ml，皮内注射0.1ml

解析：本题考查青霉素皮试液浓度和给药方法。青霉素钠、青霉素钾皮试药液浓度500U/ml，给药方法和剂量为皮内注射0.1ml（C对）。